气虚引起血虚的理论基础是
A. 血能载气
B. 血能养气
C. 气能生血
D. 气能行血
E. 气能摄血

正确答案：C。气能生血

解析：气能生血指气参与并促进血液的生成。营气直接参与血液的生成，是血液是主要构成成分（C对）；血能载气，指血液是气的载体。气存于血中，依附于血液而不致散失，赖血之运载而布于周身（A错）；血能养气，指血对气具有濡养作用（B错）；气能行血，指气具有推动血液在脉中运行的作用（D错）；气能摄血，指气具有统摄血液在脉中正常循行而不逸出脉外的作用，主要体现在脾气统血的生理功能之中（E错）。